女童，2岁，前牙外伤半小时就诊。右上乳中切牙挫入，牙冠向唇侧倾斜，不松动，牙龈淤血。患儿哭闹，无法拍摄根尖片。下一步的处理方法是
A. 观察
B. 根管治疗
C. 局麻下复位固定
D. 3个月后牵引复位
E. 拔除

正确答案：E。拔除

解析：若牙齿挫入的方向表现为牙根向恒牙胚方向，有可能对恒牙造成影响，因此应该拔除患牙。如果牙冠向舌侧倾斜，牙根有可能远离恒牙胚，可以观察自行萌出，不主张复位造成二次创伤。掌握“牙外伤概述及乳牙外伤”知识点。